人乳头瘤病毒（HPV）具有宿主的特异性。其感染宿主是
A. 人和猩猩
B. 人
C. 人与所有的灵长类
D. 人和哺乳类
E. 只感染妇女

正确答案：B。人